机体受刺激而发生应激反应的系统是
A. 交感-肾上腺髓质系统
B. 迷走-胰岛素系统
C. 下丘脑-神经垂体系统
D. 下丘脑腺垂体-甲状腺轴
E. 下丘脑-腺垂体-肾上腺皮质轴

正确答案：E。下丘脑-腺垂体-肾上腺皮质轴